患者，女，55岁，因持续性中上腹疼痛2日入院。查体：体温38℃，中上及左上腹有压痛。化验结果：白细胞计数18.7x10⁹/L，血清淀粉酶1993U/L，血脂肪酶6116U/L。其诊断可考虑是
A. 急性胰腺炎
B. 急性胆囊炎
C. 急性阑尾炎
D. 急性胃炎
E. 急性肠梗阻

正确答案：A。急性胰腺炎

解析：本题考查急性胰腺炎。淀粉酶的正常参考范围是血清80～220U/L，淀粉酶增高常见于急性胰腺炎（A对）等胰腺疾病，题干中该患者的血清淀粉酶1993U/L，超出正常范围值，可考虑为急性胰腺炎。急性胆囊炎（B错）的检查：白细胞总数及中性粒细胞约80%患者白细胞计数增高，平均在（10～15）×10⁹/L，其升高的程度和病变严重程度及有无并发症有关，若白细胞总数在20×10⁹/L以上时，应考虑有胆囊坏死或穿孔存在。急性阑尾炎（C错）典型者腹痛多自中上腹部或脐周围开始，数小时后转移至右下腹，为持续性疼痛，有阵发性加剧。急性胃炎（D错）检查：感染因素引起者末梢血白细胞计数一般轻度增高，中性粒细胞比例增高；伴肠炎者大便常规检查可见少量黏液及红、白细胞，大便培养可检出病原菌。急性肠梗阻（E错）可分作以下三型辨证论治：气滞型、瘀结型、疽结型。